下列药物中，适宜在睡前服用的是
A. 泼尼松
B. 美洛昔康
C. 多潘立酮
D. 辛伐他汀
E. 奥利司他

正确答案：D。辛伐他汀

解析：本题考查药品服用的适宜时间。宜在睡前服用的药物是辛伐他汀（D对）。胆固醇主要在夜间合成，夜间服药比白天更加有效。泼尼松（A错）属于糖皮质激素药物，宜于清晨服用。美洛昔康（B错）属于非甾体抗炎药，宜于餐中服用。多潘立酮（C错）是促胃动力药，宜于餐前服用。奥利司他（E错）属于减肥药，宜于餐中服用。